下列条件中，能加重缺血－再灌注损伤的有
A. 低温
B. 低压
C. 高钙
D. 低pH
E. 低钙

正确答案：C。高钙

解析：再灌注液体压力大小、温度、pH值以及电解质的浓度都与再灌注损伤密切相关。升高再灌注液的速度、高压（B错）、高温（A错）、高pH（D错）及高钙（C对E错）、高N a+含量，能加重再灌注损伤；或适当增加灌注液K+,Mg2+含量，有利于减轻再灌注损伤。